上颌义齿基托不需要缓冲的部位
A. 切牙乳突
B. 颧突
C. 牙槽嵴上的骨尖
D. 颤动线
E. 上颌隆突

正确答案：D。颤动线

解析：缓冲区：无牙颌的骨性隆突部位，如上颌隆突、颧突、上颌结节的颊侧、下颌隆突、下颌舌骨嵴以及牙槽嵴上的骨尖、骨棱等部位，表面被覆黏膜较薄，切牙乳突内有神经和血管。这些部位均不能承受咀嚼压力，全口义齿基托组织面在上述的相应部位应做缓冲处理，以免因压迫导致疼痛，或形成支点而影响义齿的稳定。掌握“无牙颌的解剖标志及功能分区”知识点。